有关中耳鼓室的叙述正确的是
A. 向前借咽鼓管与口咽部相通
B. 向后经乳突窦与乳突小房连通
C. 向内与内耳道相通
D. 向外与外耳道相连通
E. 蜗管

正确答案：B。向后经乳突窦与乳突小房连通

解析：鼓室是6个壁围成的含气的不规则小腔，向外借鼓膜与外耳道相隔（D错），向内毗邻内耳（C错）。鼓室向前借咽鼓管与鼻咽部（A错）相通。鼓室向后经乳突窦和乳突小房连通（B对）。E选项与题干无关。